转化过程中受体菌供体菌游离的DNA片段，获得新的遗传性状的方式是
A. 胞饮
B. 细胞融合
C. 直接摄取
D. 通过噬菌体
E. 通过性菌毛

正确答案：C。直接摄取

解析：转化是指受体菌直接摄取供体菌游离的DNA片段，从而获得新的遗传性状。掌握“细菌遗传变异的物质基础及机制”知识点。